患者25岁，男性，因右下后牙进食冷热食物痛1周，无自发痛，夜间痛史。检查：右下7颊面龋洞，探稍敏感，叩（-），松（-），牙龈（-），冷热测同对照牙。右下6颊面龋洞，探敏感，叩（-），松（-），牙龈（-），冷热测引起疼痛，去除后立即消失。其余牙未见异常，右下7颊面的诊断最可能为
A. 中龋
B. 慢性闭锁性牙髓炎
C. 浅龋
D. 深龋
E. 牙髓充血

正确答案：A。中龋

解析：本题考查中龋的诊断标准。中龋时病变进展到牙本质，探诊可稍敏感，对温度和化学刺激敏感，刺激去除后症状立即消失，温度测验同正常对照牙（A对）。慢性闭锁性牙髓炎几乎所有患者都有长期的冷热刺激痛史，对温度刺激为敏感，也可为热测引起的迟缓性疼痛,探诊患牙感觉较为迟钝，多有轻度叩痛或叩诊不适感（B错）。浅龋位于釉质内，患者一般无主观症状，遭受外界的物理和化学刺激时无明显反应，用探针检查有粗糙感，但不会引起患牙敏感（C错）。深龋时病变进展到牙本质深层，若深龋洞口开放，则食物嵌入洞内，压迫牙髓使压力增加产生疼痛，冷热刺激入洞也会产生疼痛（D错）。牙髓充血表现为对冷刺激为一过性敏感（E错）。